对大气污染状况调查和监测时，在常年主导风向或季节主导风向非常明确的情况下，其布点方式为
A. 四周布点
B. 扇形布点
C. 烟波下方布点
D. 几何状布点
E. 梅花布点

正确答案：B。扇形布点

解析：本题考查布点方式的选择。对大气污染状况调查和监测时，在常年主导风向或季节主导风向非常明确的情况下，其布点方式为扇形布点（B对ACDE错）。